地骨皮的来源及性状特征是
A. 茄科植物枸杞或宁夏枸杞的干燥根皮
B. 呈筒状、槽状或不规则卷片
C. 外表面灰黄色至棕黄色，粗糙，易成鳞片状剥落
D. 体轻，质脆，断面外层黄棕色，内层灰白色
E. 有特异香气，味微苦

正确答案：A、B、C、D。茄科植物枸杞或宁夏枸杞的干燥根皮；呈筒状、槽状或不规则卷片；外表面灰黄色至棕黄色，粗糙，易成鳞片状剥落；体轻，质脆，断面外层黄棕色，内层灰白色